女，27岁。有不洁性交史，查体：外阴有一硬结节状物。荧光密螺旋体抗体吸收试验阳性，应选择的治疗措施是
A. 静脉滴注甲硝唑
B. 肌注青霉素
C. 口服多西环素
D. 口服阿莫西林
E. 口服红霉素

正确答案：B。肌注青霉素

解析：青年女性患者，有不洁性交史，外阴有一硬结节状物（梅毒的早期主要表现为硬下疳），荧光密螺旋体抗体吸收试验阳性，诊断为梅毒，根据治疗原则，应选择的治疗措施是肌注青霉素（B对）。甲硝唑（P248）（A错）为滴虫性阴道炎或细菌性阴道病的首选用药。当青霉素禁忌时，多西环素（C错）可作为候补药物用于治疗梅毒，不作为首选。阿莫西林（D错）主要用于治疗伤寒、其他沙门菌感染和伤寒带菌者可获得满意疗效。红霉素（E错）主要应用于链球菌引起的扁桃体炎、猩红热、白喉等。